某社区老年人口的平均寿命是71.6岁，其中健康生活65.2岁（生命质量权重值为1），非卧床活动受限4.5年（生命质量权重值为0.59），卧床功能丧失1.9年（生命质量权重值为0.34），该社区老年人健康寿命年为
A. 68.5年
B. 70.3年
C. 65.2年
D. 59.7年
E. 67.8年

正确答案：A。68.5年